老年患者禁用硫酸阿托品的病症是
A. 胃溃疡
B. 青光眼
C. 胆绞痛
D. 微循环衰竭
E. 有机磷中毒

正确答案：B。青光眼

解析：本题考查硫酸阿托品的禁忌症。老年青光眼（B对）患者禁用硫酸阿托品。阿托品阻断M胆碱受体，出现扩瞳、眼内压升高，容易引起青光眼急性发作；阿托品可松弛内脏平滑肌，用于胆绞痛（C错）；能够解救有机磷酸酯中毒（E错）；胃溃疡（A错）和微循环衰竭（D错）患者可以使用阿托品。